急性化脓性阑尾炎属于
A. 变质性炎症
B. 浆液性炎症
C. 纤维素性炎症
D. 蜂窝织炎症
E. 化脓性炎症

正确答案：D。蜂窝织炎症

解析：急性化脓性阑尾炎即急性蜂窝织炎性阑尾炎，属于蜂窝织炎症（D对）。变质性炎症（A错）常见于阿米巴痢疾（P369）等。浆液性炎症（B错）常见于渗出性结核性胸膜炎、风湿性关节炎等。纤维素性炎症（C错）常见于大叶性肺炎、白喉的假膜性炎等。化脓性炎症包括蜂窝织炎症，故本题E选项不严谨。